下列属于血寒证的是
A. 寒邪束表
B. 寒邪客肺
C. 寒凝关节
D. 寒凝胃肠
E. 寒凝胞宫

正确答案：E。寒凝胞宫

解析：血寒证指寒邪客于血脉，凝滞气机，血行不畅，以拘急冷痛、形寒、肤色紫暗为主要表现的实寒证。寒凝胞宫，经血受阻，是寒客血脉致病（E对）。寒邪束表（A错）是腠理闭塞，肺卫失宣，是寒客卫表致病。寒邪客肺（B错），肺失宣降，是寒客肺部致病。寒滞胃肠（C错），使胃肠气机不利，和降、传导失常，是寒客胃肠致病。寒淫证，寒凝关节（D错），寒胜痛痹证，是寒客关节致病。